正常情况下，能使肾上腺皮质分泌醛固酮增加的是
A. 动脉血压升高
B. 细胞外液量增多
C. 血浆晶体渗透压升高
D. 血Na+浓度降低
E. 腺垂体分泌ACTH增多

正确答案：D。血Na+浓度降低